无椎体的是
A. 颈椎
B. 腰椎
C. 寰椎
D. 胸椎
E. 隆椎

正确答案：C。寰椎

解析：第 1 颈椎又名寰椎,无椎体、棘突和关节突，由前弓、后弓及侧块组成（C对）。